风湿性心脏瓣膜病并发栓塞，最常见于
A. 二尖瓣狭窄合并心力衰竭
B. 二尖瓣狭窄合并心房纤颤
C. 二尖瓣关闭不全合并心力衰竭
D. 二尖瓣关闭不全合并主动脉瓣关闭不全
E. 二尖瓣狭窄合并关闭不全

正确答案：B。二尖瓣狭窄合并心房纤颤

解析：风湿性心脏瓣膜病并发栓塞，最常见于二尖瓣狭窄合并心房纤颤（B对）。二尖瓣狭窄时，左房扩大和淤血易形成血栓，当房颤发生时血栓极易脱落，随血流运行到全身各处，引起动脉栓塞，其中以脑栓塞最为多见。二尖瓣狭窄（A错）或二尖瓣关闭不全（C错）合并心力衰竭常并发肺淤血，肺水肿。二尖瓣关闭不全合并主动脉瓣关闭不全常并发肺淤血和心力衰竭（D错）。二尖瓣狭窄合并关闭不全（E错）常合并心力衰竭。